阻滞钙通道，治疗阵发性室上性心动过速急性发作的抗心律失常药是
A. 奎尼丁
B. 胺碘酮
C. 普萘洛尔
D. 利多卡因
E. 维拉帕米

正确答案：E。维拉帕米

解析：本题考查维拉帕米。维拉帕米（E对）能阻滞心肌细胞膜钙通道，抑制钙内流，延长窦房结和房室结有效不应期和功能不应期，延缓窦房结的自律性和房室结的传导。静脉注射用于终止阵发性室上性心动过速和左心室特发性室性心动过速。奎尼丁（A错）为钠通道阻滞剂Ⅰa类抗心律失常药。胺碘酮（B对）为延长动作电位时程药，属于广谱抗心律失常药。普萘洛尔（C错）可阻断β肾上腺素受体，降低交感神经活性，主要用于室上性心律失常。利多卡因（D错）为钠通道阻滞药，仅用于室性心律失常。